患儿，5个月。因腹泻5天入院，稀水样便，尿少，哭时泪少，皮下脂肪0.3mm，足稍凉，血钠125mmol/L，本例脱水的程度及性质是
A. 轻度脱水，等渗性
B. 轻度脱水，低渗性
C. 中度脱水，等渗性
D. 中度脱水，低渗性
E. 重度脱水，低渗性

正确答案：D。中度脱水，低渗性

解析：该患儿脱水的程度及性质是中度脱水、低渗性。中度脱水的患儿尿少，哭时泪少，足稍凉。轻度脱水患儿精神稍差，哭时有泪，尿量稍减少，足尚温。轻度脱水（AB错）患儿精神稍差，略有烦躁不安。体格检查时见皮肤稍干燥，弹性尚可，眼窝和前囟稍凹陷；哭时有泪，口唇黏膜略干，尿量稍减少。重度脱水（E错）患儿呈重病容，精神极度萎靡，表情淡漠，昏睡甚至昏迷。皮肤发灰或有花纹、弹性极差；眼窝和前囟深凹陷，眼闭不合，两眼凝视，哭时无泪；口唇黏膜极干燥。因血容量明显减少可出现休克症状，如心音低钝、脉搏细速、血压下降、四肢厥冷、尿极少甚至无尿。低渗性脱水时血清钠低于130mmol/L；等渗性脱水（C错）时血清钠在130～150mmol/L；高渗性脱水时血清钠大于150mmol/L。由此可见血钠125mmol/L应属于低渗性脱水。因此该患儿脱水的程度及性质是中度脱水、低渗性（D对）。